某女，52岁。患慢性支气管炎10年，受寒后引发咳嗽经久不愈，痰少而黄、无发热，口不渴。宜选用的成药是
A. 二母宁嗽丸
B. 强力枇杷露
C. 通宣理肺丸
D. 川贝止咳露
E. 止嗽定喘口服液

正确答案：B。强力枇杷露

解析：本题考查的是强力枇杷露的主治。患慢性支气管炎10年，受寒后引发咳嗽经久不愈，痰少而黄、无发热，口不渴。宜选用的成药是强力枇杷露（B对）。强力枇杷露：【主治】痰热伤肺所致的咳嗽经久不愈、痰少而黄或干咳无痰；急、慢性支气管炎见上述证候者。二母宁嗽丸（A错）：【主治】燥热蕴肺所致的咳嗽，症见痰黄而黏不易咳出、胸闷气促、久咳不止、声哑喉痛。通宣理肺丸（C错）：【主治】风寒束表、肺气不宣所致的感冒咳嗽，症见发热、恶寒、咳嗽、鼻塞流涕、头痛、无汗、肢体酸痛。川贝止咳露（D错）：【主治】风热咳嗽，痰多上气或燥咳。止嗽定喘口服液（E错）：【主治】表寒里热，身热口渴，咳嗽痰盛，喘促气逆，胸膈满闷；急性支气管炎见上述证候者。